对违法献血法规定，向医疗机构提供不符合国家规定标准的血液的血站，应当
A. 由县级以上卫生行政部门处以罚款
B. 由县级以上卫生行政部门责令改正
C. 由县级以上卫生行政部门限期整顿
D. 依法赔偿
E. 依法追究刑事责任

正确答案：B。由县级以上卫生行政部门责令改正

解析：对违反《献血法》规定，向医疗机构提供不符合国家规定标准的血液的血站，由县级以上卫生行政部门责令改正（B对）；情节严重，造成经血液途径传播的疾病传播或者有传播严重危险的，由县级以上卫生行政部门限期整顿（C错），对直接负责的主管人员和其他直接责任人员，依法给予行政处分；构成犯罪的，依法追究刑事责任（E错）。